对已经脱尘作业的工人，还应定期作何种处理
A. 体内排尘处理
B. 服用治疗矽肺的药物
C. 脱敏治疗
D. 定期体检，以尽早发现异常
E. 不需任何处理

正确答案：D。定期体检，以尽早发现异常